女，72岁，胃癌根治术后第6天，出现上腹剧烈疼痛，逐渐加重，伴恶心，呕吐，腹胀，腹腔引流管引出咖啡色浑浊液体。查体：腹膜刺激征（+）。腹部B超提示腹腔积液。应采取的治疗措施中不包括
A. 禁食
B. 应用生长抑素
C. 肠外营养支持
D. 吗啡止痛
E. 胃肠减压

正确答案：D。吗啡止痛

解析：患者出现吻合口瘘后继发急性腹膜炎，此时患者必须禁食（A对），并留置胃管持续胃肠减压（E对），抽出胃肠道内容物和气体以减少消化道内容物继续流入腹腔，减轻胃肠内积气，改善胃壁的血运，有利于炎症的局限和吸收，促进胃肠道恢复蠕动；此时患者不能进食，应给予肠外营养支持（C对），促进疾病恢复，并给予生长抑素（B对），以减少胃内强酸性的消化液流入腹腔。吗啡可作用于胃肠道平滑肌使其肌张力提高，将进一步导致吻合口发生撕裂，加重病情（D错，为本题正确答案）。